病人口淡乏味提示
A. 痰热内盛
B. 湿热蕴脾
C. 肝胃郁热
D. 脾胃虚弱
E. 食滞胃脘

正确答案：D。脾胃虚弱

解析：口淡，指患者味觉减退，口中乏味，常伴食欲减退，属脾胃虚弱，或寒湿内阻。因脾胃运化减弱，饮食不上承于口，故口淡乏味（D对）。口黏腻，多由湿浊困阻中焦所致。如脾胃湿热、食积化热、痰热内盛（A错）等，皆可见口中黏腻不适。若口中甜而胶黏，脘闷不舒，舌苔黄腻者，为脾胃湿热。因湿热蕴脾（B错），脾胃升降失职，浊气上蒸，故见口甜黏腻。肝胃郁热证（C错），肝火横逆犯胃，木郁作酸，故见泛吐酸水，兼见嗳气不适，脘腹疼痛等。食滞胃脘证（E错），则见患者口中有酸馊味，口气酸臭，多因暴饮暴食，损伤胃肠，食积不化，胃中浊气上泛所致。